腺苷酸环化酶位于
A. 细胞膜
B. 细胞液
C. 细胞核
D. 线粒体
E. 内质网

正确答案：A。细胞膜